男，10岁，左上臂疼痛1周，有摔倒病史。查体：左上臂近段肿胀，压痛。X线片显示肱骨近侧干骺端圆形境界清楚透亮区，骨皮质膨胀变薄，无骨膜反应。首先考虑的诊断是
A. 骨囊肿
B. 骨结核
C. 骨肉瘤
D. 骨软骨瘤
E. 骨巨细胞瘤

正确答案：A。骨囊肿

解析：青少年男性患者，左上臂近段疼痛肿胀、压痛，X线片示：肱骨近侧干骺端圆形境界清楚透亮区、骨皮质膨胀变薄、无骨膜反应（骨囊肿典型影像学表现），结合患者症状体征和影像学表现，首先考虑的诊断为左肱骨近端骨囊肿（A对）。骨结核（B错）多见于脊柱，可有低热、盗汗等结核中毒症状，X线可见骨质破坏和椎间隙狭窄。骨肉瘤（C错）X线表现为骨质破坏，骨膜反应明显，可见Codman三角或呈“日光射线”形态。骨软骨瘤（D错）可长期无症状，X线表现为干骺端外生性的骨性突起。骨巨细胞瘤（E错）典型X线表现为骨端偏心位、溶骨性、囊性破坏，无骨膜反应，病灶呈肥皂泡样改变。